具有行气消积功效的药物是
A. 使君子
B. 苦楝皮
C. 槟榔
D. 贯众
E. 雷丸

正确答案：C。槟榔

解析：该题考查槟榔的功效，属记忆内容。槟榔味苦、辛，性温；入胃、大肠经；具有杀虫消积，行气，利水，截疟的功效（C对）。使君子具有杀虫消积的功效，没有行气的功效（A错）。苦楝皮具有杀虫，疗癣的功效，没有行气消积的功效（B错）。贯众具有清热解毒，凉血止血，杀虫的功效，没有行气消积的功效（D错）。雷丸具有杀虫消积的功效，没有行气的功效（E错）。